多饮、多尿、多食、体重减轻属于
A. 高血压的临床表现
B. 糖尿病的临床表现
C. 高脂血症的临床表现
D. 消化性溃疡的临床表现
E. 支气管哮喘的临床表现

正确答案：B。糖尿病的临床表现

解析：本题考查糖尿病的临床表现。糖尿病的临床表现（B对）常被描述为“三多一少”，即多尿、多饮、多食、体重减轻，许多糖尿病患者并无明显症状，仅于健康检查或因各种疾病就诊化验时发现高血糖。高血压（A错）常见症状有头痛、头晕、心悸。高脂血症的临床表现（C错）为黄色瘤，动脉粥样硬化。消化性溃疡的临床表现（D错）为周期性上腹疼痛呈反复周期性发作，节律性溃疡疼痛与饮食之间的关系具有明显的相关性和节律性。支气管哮喘（E错）患者的常见症状是发作性的喘息、气急、呼吸困难、胸闷或咳嗽等症状。